切面淡棕色，略呈角质样而油润，中心维管束木质部较大，黄白色，其外围有多数黄白色点状维管束，断续排列成2～4轮的饮片是
A. 白薇
B. 细辛
C. 牛膝
D. 白术
E. 天麻

正确答案：C。牛膝

解析：本题考查的是牛膝饮片的鉴别。切面淡棕色，略呈角质样而油润，中心维管束木质部较大，黄白色，其外围有多数黄白色点状维管束，断续排列成2～4轮的饮片是牛膝（C对）。牛膝：【性状鉴别】饮片呈圆柱形的段。外表皮灰黄色或淡棕色，有微细的纵皱纹及横长皮孔。质硬脆，易折断，受潮变软。切面平坦，淡棕色或棕色，略呈角质样而油润，中心维管束木质部较大，黄白色，其外围散有多数黄白色点状异型维管束，习称“筋脉点”，断续排列成2～4轮。气微，味微甜而稍苦涩。白薇（A错）：【性状鉴别】饮片呈不规则的段。根茎不规则形，可见圆形凹陷的茎痕，结节处残存多数簇生的根。根细，表面棕黄色。切面皮部类白色或黄白色，木部较皮部窄小，黄色。质脆。气微，味微苦。细辛（B错）：【性状鉴别】饮片呈不规则的段。根茎呈不规则圆柱形，外表皮灰棕色，有时可见环形的节。根细，外表面灰黄色，平滑或具纵皱纹，可见须根及须根痕。切面黄白色或白色。质脆。气辛香，味辛辣、麻舌。白术（D错）：【性状鉴别】饮片呈不规则厚片。表面灰黄色或灰棕色，切面黄白色或淡黄棕色，散生棕黄色的点状油室，木部具放射状纹理，烘干者切面角质样，色较深，或有裂隙。质坚实。气清香，味甘、微辛，嚼之略带黏性。天麻（E错）：【性状鉴别】饮片呈不规则的薄片，外表皮淡黄色至淡黄棕色，有时可见点状排成的横环纹。切面黄白色或淡棕色，角质样，半透明。气微，味甘。